外感风寒，误用泻下剂后，发热头痛，汗出恶风，鼻鸣微喘，舌苔薄白，脉沉缓者，治疗应选用
A. 麻黄汤
B. 桂枝汤
C. 麻黄加术汤
D. 桂枝加厚朴杏子汤
E. 石膏汤

正确答案：D。桂枝加厚朴杏子汤

解析：本题考查常见的病症的辩证、处方。题中患者外感风寒，误用泻下剂后，发热头痛，汗出恶风，鼻鸣微喘，舌苔薄白，脉沉缓，证属风寒表证误用下剂后，表证未解而微喘者。麻黄汤为解表剂，具有发汗解表，宣肺平喘之功效。主治外感风寒表实证。恶寒发热，头身疼痛，无汗而喘，舌苔薄白，脉浮紧（A错）。桂枝汤为解表剂，具有辛温解表，解肌发表，调和营卫之功效。主治头痛发热，汗出恶风，鼻鸣干呕，苔白不渴，脉浮缓或浮弱者（B错）。麻黄加术汤主治外感寒湿，恶寒发热，身体烦疼，无汗不渴，饮食无味，苔白腻，脉浮紧者（C错）。桂枝加厚朴杏子汤主治宿有喘病，又感风寒而见桂枝汤证者；或风寒表证误用下剂后，表证未解而微喘者。肺失肃降之喘逆，加厚朴、杏仁降气平喘（D对）。石膏汤主治为伤寒表证未解，里热炽盛，故解表与清里兼顾。方中石膏清热除烦为君，麻黄、豆豉发汗解表为臣，黄连、黄柏、黄芩、栀子以泻三焦之火为佐。配合成方，发表而不助里热，清热而不失治表，洵为表里双解之良剂（E错）。